（下列哪项检查）可发现局限黏膜的早期食管癌
A. 内镜检查
B. 脱落细胞检查
C. 超声波断层检查
D. 甲胎蛋白定量测定
E. 选择性动脉造影

正确答案：B。脱落细胞检查

解析：食管脱落细胞检查（B对）主要用于食管癌的筛查，可发现局部黏膜的早期食管癌。早期食管癌仅表现为局部黏膜充血水肿，内镜检查（A错）不易发现。超声波断层检查（C错）可用于判断食管癌的浸润层次、向外扩展深度等，对早期食管癌的诊断意义不大。甲胎蛋白定量测定（D错）主要用于原发性肝细胞癌的诊断。选择性动脉造影（E错）不用于食管癌的诊断。